马钱子中所含的生物碱是
A. 士的宁
B. 小檗碱
C. 氧化苦参碱
D. 莨菪碱
E. 麻黄碱

正确答案：A。士的宁

解析：本题考查的是马钱子的化学成分。马钱子中所含的生物碱是士的宁（A对）。马钱子成熟种子中生物碱含量为1.5%～5%，主要生物碱是士的宁（又称番木鳖碱）、马钱子碱及其氮氧化物，还含少量的10余种其他吲哚类生物碱，其中以士的宁含量居首，占总碱量的35%～50%，其次是马钱子碱，占总碱量的30%～40%。《中国药典》以士的宁和马钱子碱为指标成分进行含量测定，要求士的宁的含量应为1.20%～2.20%，马钱子碱的含量不得少于0.80%。小檗碱（B错）为黄连的主要成分。黄连的有效成分主要是生物碱，已经分离出来的生物碱有小檗碱（含量最高）、巴马汀、黄连碱、甲基黄连碱、药根碱和木兰碱（属于阿朴啡型）等；大多属苄基异喹啉类衍生物，季铵型生物碱。《中国药典》以小檗碱为指标成分进行含量测定。以盐酸小檗碱计，要求味连含小檗碱不得少于5.5%，表小檗碱不得少于0.80%，黄连碱不得少于1.6%，巴马汀不得少于1.5%；要求雅连含小檗碱不得少于4.5%；要求云连含小檗碱不得少于7.0%。氧化苦参碱（C错）为苦参的主要成分。苦参中主要生物碱及其化学结构：苦参所含主要生物碱是苦参碱和氧化苦参碱，《中国药典》以其为指标成分进行鉴别和含量测定，含量测定要求苦参碱和氧化苦参碱总量不得少于1.2%。此外还含有羟基苦参碱、N-甲基金雀花碱、安那吉碱、巴普叶碱和去氢苦参碱（苦参烯碱）等。这些生物碱都属于双稠哌啶类。莨菪碱（D错）为洋金花的主要成分。洋金花主要化学成分为莨菪烷类生物碱，由莨菪醇类和芳香族有机酸结合生成的一元酯类化合物。主要有莨菪碱（阿托品）、山莨菪碱、东莨菪碱、樟柳碱和N-去甲莨菪碱。《中国药典》以东莨菪碱为指标成分进行含量测定，要求东莨菪碱不得少于0.15%。麻黄碱（E错）为麻黄的主要成分。麻黄中含有多种生物碱，以麻黄碱和伪麻黄碱为主，前者占总生物碱的40%～90%，《中国药典》以盐酸麻黄碱和盐酸伪麻黄碱为指标成分进行含量测定，要求药材和饮片含盐酸麻黄碱和盐酸伪麻黄碱的总量不得少于0.80%。此外麻黄还含少量的甲基麻黄碱、甲基伪麻黄碱和去甲基麻黄碱、去甲基伪麻黄碱。